心室顺应性是指
A. 心室单位容积变化所出现的压力改变
B. 心室在单位压力变化下所引起的容积改变
C. 心室在单位压力变化下所引起的心肌长度改变
D. 心室在单位压力变化下所引起的心肌体积改变
E. 心室在单位压力变化下所引起的心脏大小改变

正确答案：B。心室在单位压力变化下所引起的容积改变

解析：心室顺应性是指心室在单位压力变化下所引起的容积改变（B对）。心室顺应性降低时，舒张末期容量减少，这种现象称为被动性舒张功能减弱。